食管癌病人有持续性胸背痛，多表示
A. 癌肿部有炎症
B. 癌已侵犯食管外组织
C. 有远处血行转移
D. 癌肿较长
E. 食管气管瘘

正确答案：B。癌已侵犯食管外组织